关于非甾体抗炎药布洛芬结构和应用的说法，错误的是
A. S-异构体的代谢产物有较高活性
B. S-异构体的活性优于R-异构体
C. 口服吸收快，Tmax约为2小时
D. 临床上常用外消旋体
E. R-异构体在体可转化为S-异构体

正确答案：A。S-异构体的代谢产物有较高活性

解析：本题考查布洛芬结构和应用。S-异构体的代谢产物无活性（A错，为本题正确答案）。布洛芬所有的代谢物均无活性。布洛芬S-异构体的活性比R-异构体强28倍（B对），通常以光学S-异构体上市，但布洛芬的R-（-）-异构体在体内可转化为S-（+）-异构体（E对），故使用时不必拆分，目前临床上使用消旋体（D对）。布洛芬口服吸收快，Tmax约为2小时（C对）。与血浆蛋白的结合率较高。体内消除快速，在服药24小时后，药物基本以原型和氧化产物形式被完全排出，所有的代谢物均无活性。